根据《国家基本药物目录管理办法（暂行）》，国家基本药物目录中生物制品分类的主要依据是
A. 临床药理学
B. 药物经济学
C. 安全性评估结果
D. 药品通用名称
E. 临床治疗首选程度

正确答案：A。临床药理学

解析：本题考查国家基本药物目录管理办法。根据《国家基本药物目录管理办法（暂行）》，国家基本药物目录中生物制品分类的主要依据是临床药理学（A对）。《国家基本药物目录管理办法》第二条国家基本药物目录中的药品包括化学药品、生物制品、中成药和中药饮片。化学药品和生物制品主要依据临床药理学分类，中成药主要依据功能分类。